关于胶体果胶铋用药教育的说法，错误的是
A. 胶体果胶铋宜与牛奶同时服用
B. 胶体果胶铋使用后口中可能有氨味
C. 胶体果胶铋使用后大便可能会变黑
D. 妊娠期妇女禁用胶体果胶铋
E. 两种铋剂不宜联用

正确答案：A。胶体果胶铋宜与牛奶同时服用

解析：本题考查胶体果胶铋的用药教育。关于胶体果胶铋用药教育的说法，错误的是胶体果胶铋宜与牛奶同时服用（A错，为本题正确答案）。铋剂应避免同服牛奶等高蛋白饮食（如牛奶），如需要合用，应至少间隔 0.5h；抗酸药可干扰本品的作用，不能同时服用。铋剂可见恶心、呕吐、便秘及腹泻。偶见轻度过敏反应。服药期间，口中可能带有氨味（B对）并可使舌苔及大便呈灰黑色（C对）。严重肾功能不全者、妊娠期妇女禁用铋剂（D对）铋剂剂量过大时（血铋浓度大于0.1ug/ml），有发生神经毒性的危险，可能导致铋性脑病现象，故为了防止铋中毒，两种铋剂不宜联用（E对）。